化妆品中易引起光变应性皮炎的物质有
A. 香料、祛臭剂、遮光剂中的某些成分
B. 漂白剂、乳化剂、脱毛剂中的某些成分
C. 影响化妆品酸碱度的某些成分
D. 香水、染料、防晒剂中的某些成分
E. 抗氧化剂、溶剂、冷烫剂中的某些成分

正确答案：D。香水、染料、防晒剂中的某些成分